手术病人从术前12小时禁食，4小时禁水是为了
A. 减少术后感染
B. 防止术后腹胀
C. 防止吻合口瘘
D. 防止术后伤口裂开
E. 防止麻醉或手术中呕吐

正确答案：E。防止麻醉或手术中呕吐

解析：术前8～12小时开始禁食，术前4小时开始禁止饮水，是为了防止因麻醉或手术过程中的呕吐（E对）而引起窒息或吸入性肺炎。减少术后感染（A错）、防止吻合口瘘（C错）和防止术后伤口裂开（D错）均需要在术中做好规范操作以及缝合规范，不是术前禁食、进水的目的；术后腹胀的发生是由于术后胃肠蠕动减慢，术前做好肠道准备、术中减少对胃肠牵拉可以防止术后腹胀的发生（B错）。